关于超抗原的性质，哪项错误
A. 无严格的MHC限制性
B. 无须APC加工可直接刺激T细胞
C. 与MHCⅡ类分子的非多态区结合
D. 参与某些病理生理过程
E. 一种超抗原只可活化少数T细胞克隆

正确答案：E。一种超抗原只可活化少数T细胞克隆